某男子坚持每晚健身1小时，每天喝可乐或雪碧约2000ml。根据中国居民平衡膳食宝塔（2016）的建议，对该男子的评价正确的是
A. 运动量太大
B. 运动量太小
C. 饮水量太多
D. 饮水量太少
E. 饮料量太多

正确答案：E。饮料量太多

解析：本题考查中国居民平衡膳食宝塔（2016）的相关内容。本题该男子坚持每晚健身1小时，每天喝可乐或雪碧约2000ml。中国居民平衡膳食宝塔（2016）的建议轻体力活动的成年人每天至少饮水1500～l700ml（约7～8杯），在高温或强体力活动的条件下应适当增加饮水量，同时提倡饮用白开水和茶水，不喝或少喝含糖饮料。可知该男子饮料量太多（E对ABCD错）。